社区获得性肺炎的病原体中，最常见的革兰阴性杆菌是
A. 厌氧菌
B. 大肠埃希菌
C. 军团菌
D. 流感嗜血杆菌
E. 肺炎克雷伯杆菌

正确答案：D。流感嗜血杆菌

解析：社区获得性肺炎（CAP）最常见的革兰阴性杆菌是流感嗜血杆菌（D对）。厌氧菌（A错）多为吸入性肺脓肿的致病菌。大肠埃希菌（B错）、肺炎克雷伯杆菌（E错）多为医院获得性肺炎病原菌。军团菌多由空调、供水系统、雾化吸入污染水源感染，不属于社区获得性肺炎的病原体最常见革兰阴性杆菌（C错）（九版内科未明确提及）。